加入局麻药溶液中常用肾上腺素浓度是
A. 1:10000～20000
B. 1:20000～30000
C. 1:50000～1:200000
D. 1:150000～180000
E. 1:200000～250000

正确答案：C。1:50000～1:200000

解析：常用肾上腺素以1:50000～1:200000的浓度加入局麻药溶液中，用作局部浸润麻醉和阻滞麻醉，也有选用血管收缩剂盐酸苯肾上腺素（新福林）等药物。掌握“颌面部常用局部麻醉药物”知识点。